关于抗抑郁药当中能发生N-脱甲基的有
A. 氯米帕明
B. 阿米替林
C. 氟西汀
D. 西酞普兰
E. 帕罗西汀

正确答案：A、B、C、D。氯米帕明；阿米替林；氟西汀；西酞普兰

解析：本题考查抗抑郁药的结构。可发生N-脱烷基化反应的抗抑郁药包括氯米帕明（A对）、阿米替林（B对）、氟西汀（C对）、西酞普兰（D对）。氯米帕明、阿米替林、西酞普兰N原子上连有两个甲基，氟西汀N原子上连有一个甲基，均可发生N-脱烷基化反应。